管理小指的皮肤感觉
A. 桡神经
B. 正中神经
C. 肌皮神经
D. 腋神经
E. 尺神经

正确答案：E。尺神经

解析：尺神经（E对）的浅支分布于小鱼际表面的皮肤、小指掌面皮肤和环指尺侧半掌面皮肤，传导其的皮肤感觉。桡神经（A错）浅支分布于手背桡 侧半皮肤和桡侧两个半手指近节背面的皮肤。正中神经（B错）感觉纤 维分布于桡侧半手掌 、桡侧三个半手指掌面皮肤及其中节和远节指背皮肤。腋神经（D错）分布于肩部和臂外侧区上部的皮肤，称为臂外侧上皮神经”。